降血糖作用最弱，作用持续时间最短的是
A. 甲苯磺丁脲
B. 氯磺丙脲
C. 格列本脲
D. 格列吡嗪
E. 胰岛素

正确答案：A。甲苯磺丁脲

解析：甲苯磺丁脲、氯磺丙脲（B错）是第一代磺酰脲类口服降糖药，格列本脲（C错）、格列吡嗪（D错）是第二代磺酰脲类口服降糖药，第二代较第一代的降血糖活性大数十倍至上百倍，其中降血糖作用最弱、作用持续时间最短的是甲苯磺丁脲（A对）。胰岛素（E错）依据起效快慢、活性达峰时间及作用持续长短可将胰岛素分为速效、中效、长效，单组分胰岛素，故其降糖作用及作用持续时间因胰岛素的种类而有所不同。